荨麻疹患者常出现
A. 血红蛋白减少
B. 中性粒细胞增多
C. 嗜酸性粒细胞增多
D. 血小板计数增多
E. 淋巴细胞增多

正确答案：C。嗜酸性粒细胞增多

解析：本题考查血常规检查。荨麻疹患者常出现嗜酸性粒细胞增多（C对）。过敏性疾病如支气管哮喘、荨麻疹、药物性皮疹、血管神经性水肿、食物过敏、血清病、过敏性肺炎等表现为嗜酸性粒细胞增多。血红蛋白减少（A错）常见于缺铁性贫血。中性粒细胞增多（B错）见于急性感染、糖尿病酮症酸中毒、汞中毒、白血病、急性大出血等。血小板计数增多（D错）见于慢性粒细胞白血病、真性红细胞增多症、急性感染、急性溶血等。淋巴细胞增多（E错）见于结核病、麻疹、风疹、流行性腮腺炎、淋巴瘤等。